影响戒烟行为的强制策略为
A. 立法
B. 吸烟危害的知识掌握与否
C. 创建无烟环境
D. 制订控烟规划
E. 开展多种形式的控烟活动

正确答案：A。立法